常用于包衣的水不溶性材料是
A. 聚乙烯醇(PVA）
B. 聚乙二醇(PEG）
C. 交联聚维酮(PVPP）
D. 聚乳酸羟乙酸(PLGA）
E. 乙基纤维素(EC）

正确答案：E。乙基纤维素(EC）

解析：本题考查常用于包衣的水不溶性材料。乙基纤维素（EC）（E对）为水不溶性包衣材料；聚乙烯醇(PVA）（A错）为水溶性包衣材料；交联聚维酮(PVPP）（C错）为崩解剂；聚乙二醇(PEG）（B错）为黏合剂；聚乳酸羟乙酸(PLGA）（D错）为合成高分子囊材。